两地汤的组成药物有
A. 白芍、生地、当归、麦冬、沙参、枸杞子
B. 白芍、当归、丹皮、川芎、牛膝、莪术
C. 白芍、熟地、丹皮、黄柏、青蒿、茯苓
D. 白芍、生地、地骨皮、麦冬、玄参、阿胶
E. 白芍、生地、当归、丹皮、沙参、茯苓

正确答案：D。白芍、生地、地骨皮、麦冬、玄参、阿胶

解析：两地汤的功效为滋阴壮水，由生地黄、 地骨皮、 玄参、 麦冬、 阿娇、 白芍组成，方歌两地地黄地骨皮，芍药麦冬玄阿胶（D对）。